吗啡对中枢神经系统的作用是
A. 镇痛，镇静，催眠，呼吸抑制，镇吐
B. 镇痛，镇静，镇咳，缩瞳，致吐
C. 镇痛，镇静，镇咳，呼吸兴奋
D. 镇痛，镇静，镇吐，呼吸抑制
E. 镇痛，镇静，扩瞳，呼吸抑制

正确答案：B。镇痛，镇静，镇咳，缩瞳，致吐